患者，男，68岁。确诊为肺癌，症见唇甲紫暗，咯痰不爽，胸痛气急，舌有瘀点，脉弦。其证型是
A. 脾肺气虚
B. 痰热搏结
C. 气滞血瘀
D. 痰湿内阻
E. 肺气郁闭

正确答案：C。气滞血瘀

解析：气滞血阻，脉络不和，积而成块，不通则痛，故胸痛气急，咯痰不爽；瘀血阻络故见唇甲紫暗，舌有瘀点；脉弦为气滞之象，可诊断为气滞血瘀证（C对）。治法为化痰散结，行气止痛，方药选用血府逐瘀汤加减。脾肺气虚（A错）的表现为神疲乏力，气短懒言，自汗。痰热搏结（B错）的特点为呼吸急促，高热不退，胸膈痞满，按之疼痛，口渴烦躁，小便黄赤，大便干燥。痰湿内阻（D错）的特点为咳嗽痰多，胸闷气短，胸胁疼痛，纳差便溏，神疲乏力。肺气郁闭（E错）咳嗽、咳痰，胸闷胀痛。